X线检查在下列疾病的诊断中具有十分重要的意义，除外
A. 急性浆液性根尖周炎
B. 邻面龋
C. 畸形中央尖
D. 根折
E. 慢性根尖周炎

正确答案：A。急性浆液性根尖周炎

解析：本题考查X线检查。X线检查在下列疾病的诊断中具有十分重要的意义，除外急性浆液性根尖周炎（A错，为本题的正确答案）。急性浆液性根尖周炎X线检查根尖周组织影像无明显异常表现。邻面龋可用X线片进行检查（B对）。畸形中央尖的X线片上显示牙根变短，髓腔粗大，牙根不能形成，根尖孔扩大呈喇叭状，X线检查有助于畸形中央尖（C对）的诊断。而根折（D对）的判定必须通过X线检查。慢性根尖周炎（E对）的X线检查可显示出患牙根尖区骨质变化的影像。